斑疹伤寒的病原体是
A. 衣原体
B. 支原体
C. 立克次体
D. 螺旋体
E. 病毒

正确答案：C。立克次体